对大出血患者应采用的治疗方法是
A. 正治
B. 从治
C. 标本兼治
D. 反治
E. 治标

正确答案：E。治标

解析：大出血时，情势危急，应当以止血为主，待血止住时，在从出血原因进行治疗（E对）；正治适用于证候本质与现象一致的病证（A错）；标本兼治适用于标本并重或标本俱缓，但单纯治标或治本都不易收效的情况（C错）；反治又称为从治，适用于疾病的征象与其本质不完全一致的情况（BD错）。